检查对乙酰氨基酚中的对氨基酚杂质，使用的试剂是
A. 三氯化铁
B. 硫酸铜
C. 硫酸铁铵
D. 亚硝基铁氰化钠
E. 三硝基苯酚

正确答案：D。亚硝基铁氰化钠